男，60岁。因社区获得性肺炎入院，应用莫西沙星治疗。已知莫西沙星的表观分布容积（Vd）值为4L/kg，为了使患者血药浓度尽快达到有效治疗的稳态血药浓度5mg/L，需要静脉给予患者的负荷剂量为
A. 40mg/kg
B. 15mg/kg
C. 10mg/kg
D. 20mg/kg
E. 5mg/kg

正确答案：D。20mg/kg

解析：已知莫西沙星的表观分布容积（Vd）值为4L/kg，稳态血药浓度5mg/L，根据公式Vd=A/C0，可得出A=Vd×C0=4L/kg×5mg/L=20mg/kg（D对）。